紫癜风热伤络证的治法是
A. 滋阴降火，凉血止血
B. 疏风散邪，清热凉血
C. 理气化瘀，活血止血
D. 健脾养心，益气摄血
E. 清热解毒，凉血止血

正确答案：B。疏风散邪，清热凉血

解析：滋阴降火，凉血止血为紫癜阴虚火旺证的治法（A错）。风热之邪外感，内窜血络而致紫癜，治疗用疏风散邪，清热凉血（B对）。理气化瘀，活血止血为气滞血瘀所致的出血（C错）。健脾养心，益气摄血为紫癜气不摄血证的治法（D错）。清热解毒，凉血止血为紫癜血热妄行证的治法（E错）。